腮腺咬肌筋膜来自于
A. 颈浅筋膜
B. 颈深筋膜浅层
C. 颈深筋膜中层
D. 颈鞘
E. 颈脏器筋膜

正确答案：B。颈深筋膜浅层

解析：腮腺咬肌筋膜为颈深筋膜浅层向上的延续，在腮腺后缘分为深、浅两层，包绕腮腺形成腮腺鞘，两层在腮腺前缘处融合，覆盖于咬肌表面，称为咬肌筋膜。掌握“腮腺咬肌区、腮腺与面神经解剖关系”知识点。